乳糖中特殊杂质蛋白质的检查所使用的试液是
A. 硝酸银试液
B. 硝酸汞试液
C. 醋酸铅试液
D. 硫酸铜试液
E. 硫酸钠试液

正确答案：B。硝酸汞试液